某女，40岁。胃脘胀痛，痛连两胁，遇烦恼则痛甚，嗳气、矢气则舒，脘闷嗳气，善太息，大便不畅。舌淡红，苔薄白，脉弦。诊断为胃痛，证属肝气犯胃。可选用的中成药有
A. 沉香化气丸
B. 沉香化滞丸
C. 开胸顺气丸
D. 朴沉化郁丸
E. 舒肝和胃丸

正确答案：A、D、E。沉香化气丸；朴沉化郁丸；舒肝和胃丸

解析：本题考查胃痛之肝气犯胃证的常用中成药。结合患者症状为胃痛之肝气犯胃证，宜选用沉香化气丸（A对）、朴沉化郁丸（D对）、舒肝和胃丸（E对）胃痛之。肝气犯胃证【症状】胃脘胀痛，痛连两胁，遇烦恼则痛作或痛甚，嗳气、矢气则舒，脘闷嗳气，善太息，大便不畅。舌淡红，苔薄白，脉弦。【中成药应用】沉香化气丸、朴沉化郁丸、舒肝和胃丸、舒肝和胃丸（大蜜丸）、调胃舒肝丸。胃痛之饮食伤胃证【症状】胃脘疼痛，胀满拒按，嗳腐恶食，或吐不消化食物，吐后或矢气后痛减，大便不爽。舌淡红，苔厚腻，脉滑。【中成药应用】槟榔四消丸（大蜜丸）、开胸顺气丸（C错）、沉香化滞丸（B错）、加味保和丸。